足跖屈和足外翻的是
A. 腓肠肌
B. 胫骨前肌
C. 胫骨后肌
D. 腓骨长肌
E. 第三腓肌

正确答案：D。腓骨长肌

解析：腓肠肌（A错）屈踝关节和膝关节。胫骨前肌（B错）伸踝关节（背屈）和使足内翻。胫骨后肌（C错）屈踝关节和使足内翻。腓骨长肌（D对）屈踝关节（跖屈）和使足外翻。